下列哪个部位最容易听到正常肺泡呼吸音
A. 乳房上部
B. 肩胛上部
C. 肩胛下部
D. 胸骨上窝
E. 胸骨角附近

正确答案：C。肩胛下部

解析：肺泡呼吸音是由于空气在细支气管和肺泡内进出移动的结果。吸气时气流经支气管进入肺泡，冲击肺泡壁，使肺泡由松弛变为紧张，呼气时肺泡由紧张变为松弛，这种肺泡弹性的变化和气流的振动是肺泡呼吸音形成的主要因素。正常肺泡呼吸音的最明显听诊部位在乳房下部、肩胛下部（C对）、腋窝下部，而乳房上部（A错）、肩胛上部（B错）一般听不到肺泡呼吸音。胸骨上窝（D错）为支气管呼吸音较明显的听诊部位。胸骨角附近（E错）为支气管肺泡呼吸音较明显的听诊部位。